下述牙冠轴面突度生理意义中正确的是
A. 正常的牙冠突度可促进血液循环
B. 牙冠颈1/3的突度，还可起到扩展龈缘的作用
C. 牙冠突度过小或无突度，牙龈将会受食物直接撞击而受伤
D. 牙冠突度过大，牙龈会失去食物对其的按摩作用，可能产生废用性萎缩
E. 以上均正确

正确答案：E。以上均正确

解析：本题考查牙冠轴面突度的生理意义。咀嚼时，正常的牙冠突度可使排溢的食物经过牙龈表面时对牙龈起到生理性按摩作用，促进牙龈的血液循环（A对），有利于牙龈组织的健康。若牙冠突度过小或无突度，牙龈将会受到食物的直接撞击而受伤（C对）；反之,若牙冠突度过大，牙龈会失去食物对其的按摩作用，可能产生失用性萎缩（D对）。牙冠颈1/3的突度，还可起到扩展龈缘的作用（B对），使其紧张而有力。综上所述，以上均正确（E对，为本题正确答案）。